药物从给药部位进入体循环的过程是
A. 药物的吸收
B. 药物的分布
C. 药物的代谢
D. 药物的排泄
E. 药物的消除

正确答案：A。药物的吸收

解析：本题考查药物的体内过程。药物的吸收（A对）是指药物从给药部位进入体循环的过程；药物的分布（B错）是指药物进入体循环后向各组织、器官或者体液转运的过程；药物的代谢（C错）是指药物在吸收过程或进入体循环后，受体内酶系统的作用，结构发生转变的过程；药物的排泄（D错）是指药物及其代谢产物排出体外的过程；药物的消除（E错）是指代谢和排泄。